小儿夏季热的临床特征除长期发热外，可见
A. 口渴多饮、多尿、汗闭
B. 口渴多饮、多尿、多汗
C. 口渴多饮、少尿、多汗
D. 口不渴、多尿、多汗
E. 口不渴、少尿、汗闭

正确答案：A。口渴多饮、多尿、汗闭

解析：夏季热多见于三岁以下的小儿，临床以长期发热、口渴多饮、多尿、汗闭为特征（A对）。（BCDE错）。